用活疫苗进行预防接种，可有效控制的病毒性疾病是
A. 狂犬病
B. 脊髓灰质炎
C. 艾滋病（AIDS）
D. 乙型肝炎
E. 流行性乙型脑炎

正确答案：B。脊髓灰质炎